下列哪组疾病均可经水传播
A. 伤寒、霍乱、钩虫病
B. 血吸虫病、甲型肝炎、钩端螺旋体病
C. 伤寒、霍乱、出血热
D. 霍乱、痢疾、斑疹伤寒
E. 甲型肝炎、戊型肝炎、恙虫病

正确答案：B。血吸虫病、甲型肝炎、钩端螺旋体病